Ⅰ型糖尿病的主要特点是
A. 起病缓慢
B. 对胰岛素不敏感
C. 有明显的遗传易感性
D. 很少发生酮症酸中毒
E. 胰岛素绝对缺乏

正确答案：E。胰岛素绝对缺乏